生物碱多存在于
A. 单子叶植物
B. 双子叶植物
C. 蕨类植物
D. 裸子植物
E. 藻类植物

正确答案：C。蕨类植物